球状突与上颌突未联合或部分联合所致的是
A. 唇裂
B. 腭裂
C. 上颌裂
D. 牙槽突裂
E. 面裂

正确答案：A。唇裂

解析：唇裂多见于上唇，是球状突和上颌突未联合或部分联合所致。掌握“面部的发育”知识点。